可降低外周血管阻力，还可减轻前列腺增生症状的药物是
A. 坎地沙坦
B. 格列吡嗪
C. 利血平
D. 哌唑嗪
E. 甲基多巴

正确答案：D。哌唑嗪

解析：本题考查药物的作用特点。哌唑嗪（D对）是α₁受体阻断剂，可降低外周血管阻力，对心输出量影响不大，起效快，作用强，改善胰岛素抵抗，并能降低 TC、TG与LDL-ch，升高HDL-ch，对高脂症血患者有利，还可以减轻前列腺增生。坎地沙坦（A错）为选择性血管紧张素Ⅱ受体（AT₁）拮抗剂，通过与血管平滑肌AT₁受体结合而拮抗血管紧张素Ⅱ的血管收缩作用，从而降低末梢血管阻力，达到降压作用。格列吡嗪（B错）为第二代磺脲类口服降血糖药。主要是促进胰岛β细胞分泌胰岛素，尤其是促进葡萄糖刺激的胰岛素β细胞分泌，从而有效地降低血糖浓度和糖基化血红蛋白；并可改善高脂血症，降低甘油三酯和胆固醇水平。利血平（C错）属于神经末梢抑制剂，主要是使交感神经末梢囊泡内的神经递质释放，又阻止该物质再入囊泡，而使囊泡内神经递质逐渐减少或耗竭，导致交感神经冲动传导受阻，从而达到降压作用。甲基多巴（E错）是通过作用于中枢神经系统，激活血管运动神经中枢α₂受体，减少交感神经冲动传出，降低血压。